目前我国传染病疫情信息主要通过以下什么方式进行报告
A. 逐级上报
B. 定期报告
C. 网络直报
D. 电话报告
E. 以上均可

正确答案：C。网络直报

解析：本题考查传染病疫情信息的报告方式。目前我国传染病疫情信息主要通过网络直报（C对ABDE错）方式进行报告。